男，68岁。排便习惯改变3个月，便中带血1周，查体：浅表淋巴结未触及肿大，腹平软，未触及包块，移动性浊音（-），肠鸣音正常。直肠指诊：直肠前壁距肛缘4cm菜花型肿物，侵及直肠1/4周径，肿物直径2cm，指套染血。为明确诊断及选择治疗方式，最佳的辅助检查是
A. 腹部MRI
B. 腹部CT
C. 腹部B超
D. 直肠镜
E. 结肠镜

正确答案：E。结肠镜

解析：老年患者，排便习惯改变，便中带血，直肠前壁有菜花型肿物，初步诊断为直肠癌。直肠镜和结肠镜均可明确诊断，直肠癌部分为多发癌，为选择治疗方式，应选择探查部位更广泛的结肠镜（E对D错）。腹部MRI（A错）、腹部CT（B错）、腹部B超（C错）可作影像上的辅助诊断，不能确诊。